男，40岁。患十二指肠球部溃疡穿孔，急症上腹正中切口行胃大部切除术，并置切口内乳胶片引流。一般拔除引流片的时间为术后
A. 9～10天
B. 1～2天
C. 7～8天
D. 3～4天
E. 5～6天

正确答案：B。1～2天

解析：腹部手术关腹前应彻底清除腹腔内残留的液体和异物，恢复腹腔内脏器的正常解剖关系；用生理盐水冲洗腹腔，污染严重的部位应反复冲洗；根据需要选用乳胶管引流或双套管负压吸引；腹壁切口污染不重者，可以分层缝合，污染较重者，可在皮下可放置乳胶片引流，置于皮下等较表浅部位的乳胶片引流一般在术后1～2天拔除（B对）。